以下哪项的目的是调动个体、群体的积极性，有效地利用资源达到最大的健康效果
A. 健康管理
B. 健康咨询
C. 健康教育
D. 健康评估
E. 疾病预防

正确答案：A。健康管理

解析：健康管理的目的是调动个体、群体及整个社会的积极性，有效地利用有限的资源达到最大的健康效果。掌握“临床预防服务概述”知识点。